与氨曲杆（1:2）配伍，可抑制酶药
A. 青霉素V
B. 苯唑西林
C. 替卡西林
D. 哌拉西林
E. 舒巴坦

正确答案：E。舒巴坦